女，32岁。双腕和膝关节疼痛，伴高热2个月。曾有癫痫样发作一次。心脏超声检查示中等量心包积液；X线胸片示右侧少量胸腔积液。血常规检查Hb、WBC和血小板下降。尿蛋白（++），多种抗生素治疗无效，最可能诊断
A. 肾小球肾炎急性发作
B. 恶性肿瘤颅内转移
C. 系统性红斑狼疮
D. 结核性胸膜炎和心包炎
E. 再生障碍性贫血

正确答案：C。系统性红斑狼疮

解析：该患者的临床表现属于多器官受累，具有系统性红斑狼疮的诊断标准中的5项，①神经系统病变：癫痫样发作；②关节炎2个；③浆膜炎：胸膜炎或心包炎：④血液系统异常：Hb、WBC和血小板下降：⑤肾脏病变：尿蛋白(++），故可以考虑诊断系统性红斑狼疮（C对）。